能与Molish试剂呈阳性反应的有
A. 山柰酚
B. 芦丁
C. 芹菜素-7-O-葡萄糖
D. 木犀草素-7-O-葡萄糖
E. 橙皮苷

正确答案：B、C、D、E。芦丁；芹菜素-7-O-葡萄糖；木犀草素-7-O-葡萄糖；橙皮苷

解析：本题考查的是糖苷类显色反应。能与Molish试剂呈阳性反应的有芦丁（B对）、芹菜素-7-O-葡萄糖（C对）、木犀草素-7-O-葡萄糖（D对）与橙皮苷（E对）。苷类化合物由苷元和糖两部分组成，故苷类化合物能发生相应的苷元和糖的各种显色反应。苷元的结构多种多样。糖的显色反应中最重要的是Molish反应，常用的试剂由浓硫酸和α-萘酚组成。芦丁、木犀草素-7-O-葡萄糖与橙皮苷为黄酮苷、芹菜素-7-O-葡萄糖为碳苷，其分子中均含糖，可发生Molish反应。山柰酚（A错）为黄酮类化合物，分子中不含糖，故不能发生Molish反应。